不得在互联网上销售药品的是
A. 药品上市许可持有人
B. 药品零售企业
C. 医疗机构
D. 药品批发企业

正确答案：C。医疗机构

解析：本题考查网络销售药品的条件。药品网络销售者应当是取得互联网药品信息服务资格证书的药品上市许可持有人（A对）、药品经营企业（BD对）。其他企业、机构及个人不得从事药品网络销售，法律法规另有规定的除外，因此医疗机构（C错，为本题正确答案）不得从事药品网络销售。